下列各项，除哪项外，均是内伤咳嗽的常见病因
A. 情志刺激
B. 饮食不节
C. 过劳努伤
D. 肺脏虚弱
E. 久病伤阴

正确答案：C。过劳努伤

解析：情志不遂，郁怒伤肝，肝气郁结，失于条达，气机不畅，日久气郁化火，因肝脉布胁而上注于肺，故气火循经犯肺，可造成内伤咳嗽之肝火犯肺证（A对）。因嗜好烟酒等辛温燥烈之品，熏灼肺胃，酿生痰热；或因过食肥甘厚味，伤及脾胃，痰浊内生，可造成内伤咳嗽之痰浊蕴肺证（B对）。肺主气司呼吸功能失常，以致肺虚而肃降无权，肺气上逆（D对），又或肺系疾病反复迁延不愈，伤阴耗气，可造成内伤咳嗽之痰浊蕴肺证（E对）。外感或内伤导致肺气失于宣发、肃降时，均会使肺气上逆而引起咳嗽，而过劳努伤常常不会直接影响脏腑而发为咳嗽（C错，为本题正确答案），因此不是内伤咳嗽的常见病因。